某男，68岁。半年前因中风，遗留半身不遂，口眼㖞斜，言语謇涩，出院后常规服用阿司匹林肠溶片（每次100mg，每日1次）。近2周，因过度劳累，患侧肢体无力、活动不便加重，伴浮肿，面色少华；伸舌右偏，舌色淡紫，舌边有瘀斑，苔薄白，脉细涩无力。医师诊断为中风，证属气虚血瘀，处方如下：黄芪30g，桃仁10g，当归6g，川芎9g，红花10g，赤芍10g，地龙6g，半夏6g，7剂，水煎服，每日1剂，早、晚分服。1周后患者因外感风寒内伤湿滞症见头痛昏重、胸膈痞闷、脘腹胀痛、呕吐泄泻医师予以藿香正气水内服执业药师应告知正确的服用方法是
A. 餐前服用藿香正气水，餐后服用阿司匹林肠溶片
B. 餐前服用藿香正气水，餐中服用阿司匹林肠溶片
C. 餐中服用藿香正气水，餐前服用阿司匹林肠溶片
D. 餐后服用藿香正气水，餐前服用阿司匹林肠溶片
E. 餐后服用藿香正气水，餐中服用阿司匹林肠溶片

正确答案：D。餐后服用藿香正气水，餐前服用阿司匹林肠溶片

解析：本题考查的是服药时间。半年前因中风，遗留半身不遂，口眼㖞斜，言语謇涩，出院后常规服用阿司匹林肠溶片（每次100mg，每日1次）。近2周，因过度劳累，患侧肢体无力、活动不便加重，伴浮肿，面色少华；伸舌右偏，舌色淡紫，舌边有瘀斑，苔薄白，脉细涩无力。医师诊断为中风，证属气虚血瘀，处方如下：黄芪30g，桃仁10g，当归6g，川芎9g，红花10g，赤芍10g，地龙6g，半夏6g，7剂，水煎服，每日1剂，早、晚分服。1周后患者因外感风寒内伤湿滞症见头痛昏重、胸膈痞闷、脘腹胀痛、呕吐泄泻医师予以藿香正气水内服执业药师应告知正确的服用方法是餐后服用藿香正气水，餐前服用阿司匹林肠溶片（D对）。服药时间：药性不同、治疗的疾病不同，服药的时间也各不相同。（1）空腹服：活血化瘀药宜空腹服药，如桃核承气汤。峻下逐水药空腹服可使药力直达病所，如十枣汤方。此外，驱虫药空腹服可使药效更佳；攻积导滞药空腹服可使泻下之力更强。（2）饭前服：补益药宜饭前服以利于吸收，如六味地黄丸、参芩白术散等；制酸药宜饭前服，以减少胃酸分泌，增强对胃黏膜的保护；病在胸膈以下，如肝、肾等脏器疾病宜饭前服，旨在使药力直达病所，发挥最佳效力。（3）饭后服：对胃肠道有刺激的药物及苦寒伤胃之药宜饭后服；健胃消食药宜饭后服，如保和丸、大山楂丸等；病在胸膈以上，如头痛、眩晕、目疾、咽痛等宜饭后服，使药效停留于上焦，便于发挥药效。（4）清晨服：利水蠲饮祛湿剂可于清晨服，如鸡鸣散。此外涌吐药如常山饮、七宝饮等亦宜清晨服用。（5）清晨至午前服：凡需借助阳气扶正祛邪的方药，均宜清晨至午前服。发汗解表药宜取清晨至午前分温三服，病瘥即止，如桂枝汤、麻黄汤、桂枝加葛根汤、九味羌活汤等即宜午前服。此外凡温补肾阳、温阳健脾等的方药，亦宜清晨至午前服，借助阳气充盛之势增强扶正祛邪之药效，如金匮肾气丸、附子理中丸、右归丸等。（6）午后至夜晚服：具有滋阴潜阳、清热解毒、重镇固摄的中药，应在午后至夜晚服，此时为阳中之阴、阴中之阴，可助药物发挥养阴、清热、摄纳、潜藏的功效。例如寒下之剂宜午后至夜晚分服。（7）睡前服：安神药宜睡前服，如酸枣仁汤、朱砂安神丸、天王补心丸等；涩精止遗药宜睡前服，以便增强治疗梦遗滑精之效；部分缓泻药宜睡前服，以便翌日清晨排便；治疗夜汗出、夜半腹痛者，均宜睡前服用。（8）疾病发作时服：截症药宜于症疾发作前2～4小时服用；平喘药宜于哮喘发作前两小时服用。（9）其他：急性病应立即服药；慢性病宜定时服药；调经药应于经前或经期服用；呕吐、惊厥、石淋、咽喉病须煎汤代茶饮者，均可不定时服药。